患者心绞痛，血压85/60mmhg，有休克，心率34次/分，治疗用药为
A. 肾上腺素
B. 去甲肾上腺素
C. 异丙肾上腺素
D. 多巴胺
E. 阿托品

正确答案：E。阿托品

解析：患者心绞痛，血压85/60mmhg，有休克，心率34次/分，结合患者的心绞痛病史，低血压休克，心率慢等表现，应给予阿托品治疗（E对）。（P319）肾上腺素是 CPR 的首选药物（A错）。应用升压药 补充血容量后血压仍不升，而 PCWP （肺毛细血管楔压）和CI （心排血指数）正常时，提示周围血管张力不足，可用多巴胺…或去甲肾上腺素 …亦可选用多巴酚丁胺（BD错）。（P173）异丙肾上腺素易诱发室性心律失常，故不宜应用（C错）。